往往不相信医生的诊断，否认自己患心理疾病的患者人群为
A. 儿童患者
B. 青年患者
C. 更年期患者
D. 女性患者
E. 老年患者

正确答案：B。青年患者